水解后易被氧化而显绿色
A. 黄芩苷
B. 葛根素
C. 二者均有此性质
D. 二者均无此性质

正确答案：A。黄芩苷

解析：本题考查的是黄芩中主要成分及其化学结构。水解后易被氧化而显绿色的是黄芩苷（A对）。黄芩苷为淡黄色针晶，几乎不溶于水，难溶于甲醇、乙醇、丙酮，可溶于热乙酸。遇三氯化铁显绿色，遇乙酸铅生成橙红色沉淀。溶于碱及氨水中初显黄色，不久则变为黑棕色。经水解后生成的黄芩素分子中具有邻三酚羟基，易被氧化转为醌类衍生物而显绿色，这是保存或炮制不当的黄芩能够变绿的原因。葛根素（B错）分子中无邻三酚羟基，不易被氧化转为醌类衍生物而显绿色。